在复方乙酰水杨酸片中，可作为稳定剂的辅料是
A. 轻质液体石蜡
B. 淀粉浆（15%～17%）
C. 滑石粉
D. 干淀粉
E. 酒石酸

正确答案：E。酒石酸

解析：本题考查复方乙酰水杨酸片的处方分析。乙水酰杨酸遇水易水解成水杨酸和醋酸，其中水杨酸对胃黏膜有较强的刺激性，长期应用会导致胃溃疡。因此，本品中加入乙酸水杨酸量1%的酒石酸（E对），可有效地减少乙水酰杨酸水解，避免水杨酸对胃黏膜的刺激。淀粉浆（15%～17%）（B错）作为黏合剂。滑石粉（C错）作为润滑剂。干淀粉（D错）作为崩解剂。